破裂后液体进入腹腔引起腹膜刺激征最严重的腹部实质脏器是
A. 肾上腺
B. 肾脏
C. 肝脏
D. 胰腺
E. 脾脏

正确答案：D。胰腺

解析：腹腔脏器破裂后，消化液或血液等液体进入腹腔，可引起腹膜刺激征。其中，消化液以胃液、胆汁、胰液刺激最强。肝脏（C错）破裂后肝胆汁流入腹腔引起的腹膜刺激征不如胰腺（D对）破裂胰液流入腹腔引起的腹膜刺激征强烈。肾上腺（A错）、肾脏（B错）及脾脏（E错）破裂后，流入腹腔内的液体主要是血液，血液对腹膜的刺激最轻，因此腹膜刺激征不明显。